缺铁性贫血的原因可能有
A. 慢性失血，如钩虫病、痔疮、溃疡病、月经量过多等
B. 长期营养摄入不足
C. 妇女妊娠或哺乳
D. 造血因子（叶酸、维生素B₁₂）缺乏
E. 脱氧核糖核酸（DNA）合成出现障碍

正确答案：A、B、C。慢性失血，如钩虫病、痔疮、溃疡病、月经量过多等；长期营养摄入不足；妇女妊娠或哺乳

解析：本题考查缺铁性贫血。缺铁性贫血原因主要包括四种，慢性失血，如钩虫病、痔疮、溃疡病、月经量过多等（A对）属于铁丢失增加；长期营养摄入不足（B对）属于铁摄入不足；妇女妊娠或哺乳（C对）属于需铁量增加。此外还有铁吸收或利用减少。造血因子（叶酸、维生素B₁₂）缺乏（D错）和脱氧核糖核酸（DNA）合成出现障碍（E错）不会引起缺铁性贫血。